根据《中华人民共和国中医药法》，关于医疗机构中药饮片炮制管理的说法，错误的是
A. 对市场上没有供应的中药饮片，医疗机构可以根据本医疗机构医师处方的需要，在本医疗机构内炮制、使用
B. 医疗机构炮制中药饮片，应当向所在地设区的市级人民政府药品监督管理部门备案
C. 医疗机构可以根据临床用药需要，凭本医疗机构医师的处方对中药饮片进行再加工
D. 对市场上没有供应的中药配方颗粒，医疗机构可以按照本省中药饮片炮制规范进行制备

正确答案：D。对市场上没有供应的中药配方颗粒，医疗机构可以按照本省中药饮片炮制规范进行制备

解析：本题考查《中医药法》对医疗机构中药饮片管理的规定。（D错，为本题正确答案）。《中医药法》对医疗机构中药饮片管理的规定：对市场上没有供应的中药饮片，医疗机构可以根据本医疗机构医师处方的需要，在本医疗机构内炮制、使用（A对）。医疗机构应当遵守中药饮片炮制的有关规定，对其炮制的中药饮片的质量负责，保证药品安全。医疗机构炮制中药饮片，应当向所在地设区的市级人民政府药品监督管理部门备案（B对）。根据临床用药需要，医疗机构可以凭本医疗机构医师的处方对中药饮片进行再加工（C对）。不得将尚处于科学研究阶段、未获得公认的安全性、有效性方面数据的科研产品，以及片剂、颗粒剂等常规按制剂管理的产品作为中药饮片管理，并不得为其制定中药饮片炮制规范。